学习环境卫生学的主要目的是使预防医学专业的学生
A. 提高诊断疾病的本领
B. 认识疾病在人群中流行的原因
C. 了解污染物在环境中的分布规律
D. 认识全球环境问题
E. 认识自然环境和生活环境与人群健康的关系

正确答案：E。认识自然环境和生活环境与人群健康的关系

解析：本题考查学习环境卫生学的主要目的。环境卫生学是研究自然环境和生活环境与人群健康的关系（E对ABCD错），揭示环境因素对人群健康影响的发生、发展规律，为充分利用环境有益因素和控制环境有害因素提出卫生要求和预防对策，增进人体健康，维护和提高人群健康水平的学科。